两样本均数比较的假设检验，按α=0.05水准，认为差异无显著性，此时若推断有错，其错误的概率是
A. 大于0.05
B. 小于0.05
C. 等于0.05
D. β，而具体数值未知
E. 1－β

正确答案：D。β，而具体数值未知